正常情况下自然牙列对刃（牙合）的特点是
A. 当前牙切缘相对时，后牙无接触或轻接触
B. 前牙接触，后牙也接触
C. 前不接触，后牙接触
D. 前牙不接触，后牙不接触
E. 以上均不对

正确答案：A。当前牙切缘相对时，后牙无接触或轻接触

解析：自然牙列对刃（牙合）的特点是正常情况下，当前牙切缘相对时，后牙无接触或轻接触。但是有些个体由于牙列的生理性磨耗，可以由早期的对刃（牙合）后牙无接触，逐渐变为对刃（牙合）后牙有接触（无早接触），形成平衡（牙合）。掌握“牙尖交错（牙合）、前伸（牙合）及侧（牙合）”知识点。